下列哪种疾病不引起牙本质过敏症
A. 磨损
B. 龋病
C. 牙周萎缩，牙颈部外露
D. 牙髓坏死
E. 楔状缺损

正确答案：D。牙髓坏死

解析：牙本质过敏症不是一种独立的疾病，而是多种牙体疾病共有的症状。是牙齿受到外界刺激，如温度（冷、热）、化学物质（酸、甜）以及机械作用（摩擦、咬硬物）等引起的酸痛症状，当用尖锐的探针在牙面上滑动时，可找到一个或数个过敏区，它发作迅速、疼痛尖锐、时间短暂，是各种牙体疾病的共有症状，是由于釉质的完整性受到破坏牙本质暴露所致，磨耗、楔状缺损、牙折、龋病、牙周萎缩均可发生牙本质过敏。掌握“牙本质敏感症”知识点。